为不规则厚片，切面半透明，周边较皱缩，偶见盘状茎痕，有黏性，味甜的是
A. 白蔹饮片
B. 秦艽饮片
C. 黄精饮片
D. 射干饮片
E. 天冬饮片

正确答案：C。黄精饮片